熊胆中主要化学成分是
A. 鹅去氧胆酸
B. 丁醇衍生物
C. 乙醇衍生物
D. 胆甾醇
E. 胆红素

正确答案：A、D、E。鹅去氧胆酸；胆甾醇；胆红素

解析：本题考查的是熊胆的主要化学成分。熊胆中主要化学成分是鹅去氧胆酸（A对）、胆甾醇（D对）与胆红素（E对）。熊胆的化学成分为胆汁酸类的碱金属盐及胆甾醇和胆红素。从生物活性方面讲，其主要有效成分为牛磺熊去氧胆酸，此外还有鹅去氧胆酸、胆酸和去氧胆酸。